某地区卫生局对各医院口腔科近3年儿童牙外伤病历进行分析，以找出牙外伤最主要的原因。这种研究方法是
A. 横断面研究
B. 历史常规资料分析
C. 群组研究
D. 病例对照研究
E. 实验研究

正确答案：B。历史常规资料分析

解析：本题通过对各医院口腔科近3年牙外伤病历进行分析，这是一种从现在分析以前资料的方法，这种回顾性研究只出现在两种情况时，一种是病例-对照研究，另一种是历史常规资料分析。而病例-对照研究需要设立病例组和对照组，历史常规资料分析则只从病历资料中分析即可。掌握“口腔流行病学概述及研究方法”知识点。